治疗新生儿破伤风时镇静剂的应用原则应除外
A. 常用药物为氯丙嗪、巴比妥钠、水合氯醛
B. 各药可交替使用
C. 保持患儿呈嗜睡状态
D. 保持患儿呈清醒状态
E. 避免镇静剂用量过大

正确答案：D。保持患儿呈清醒状态

解析：本题考查新生儿破伤风时镇静剂的应用原则。新生儿破伤风时使用镇静剂时保持患儿呈嗜睡状态（D错，为本题正确答案）。新生儿破伤风时镇静剂的应用原则：常用药物为氯丙嗪、巴比妥钠、水合氯醛（A对）且各药可交替使用（B对），保持患儿呈嗜睡状态（C对），避免镇静剂用量过大（E对）。